具有宁心安神功效的药物是
A. 苏合香
B. 麝香
C. 远志
D. 蟾酥
E. 牛黄

正确答案：C。远志

解析：远志性味辛苦温，归心肾肺经，其功效为安神益智，交通心肾，祛痰开窍，消散痈肿（C对）。苏合香的功效为开窍醒神，辟秽，止痛（A错）。麝香的功效为开窍醒神，活血通经，消肿止痛（B错）。蟾酥的功效为解毒，止痛，开窍醒神（D错）。牛黄的功效为凉肝息风，清心豁痰，开窍醒神，清热解毒（E错）。